可增强吗啡对平滑肌的松弛作用的药物是
A. 苯甲酸钠咖啡因
B. 纳洛酮
C. 阿托品
D. 氟马西尼
E. 溴吡斯的明

正确答案：C。阿托品

解析：本题考查药物的相互作用。可增强吗啡对平滑肌的松弛作用的药物是阿托品（C对）；苯甲酸钠咖啡因（A错）又称安钠咖，为强心利尿药，也可作中枢神经兴奋药；纳洛酮（B错）可用于吗啡中毒的解救；氟马西尼（D错）用于苯二氮䓬类药物过量或中毒；溴吡斯的明（E错）可用于重症肌无力、术后腹气胀或尿潴留及对抗非去极化型肌松药的肌松作用。